药物经济学与随机临床试验的不同在于
A. 研究目的
B. 比较对象
C. 研究结果
D. 样本大小
E. 研究周期

正确答案：A、B、C、D、E。研究目的；比较对象；研究结果；样本大小；研究周期